一产妇分娩时产道出血400ml，血压100/65mmHg，Hb110g/L。因平时身体虚弱，其家属要求输血以补充营养和加快恢复体力，此时正确的处理是
A. 输注全血2单位
B. 输注红细胞悬液2单位
C. 输注新鲜冰冻血浆400ml
D. 加强饮食营养，但不输注任何血液制品
E. 输注人血白蛋白

正确答案：D。加强饮食营养，但不输注任何血液制品

解析：本例患者出血小于总血容量的10%（500ml），Hb正常（刚分娩产妇身体状况与孕妇相似，其Hb低于100g/L方能视为贫血），可通过机体自身组织间液向血液循环的转移而得到代偿，不需输注任何血液制品（ABCE错）。患者平时身体虚弱，可给予加强饮食治疗（D对）。